通过抑制钾通道，延长动作电位时程的抗心律失常药物是
A. 胺碘酮
B. 普罗帕酮
C. 美西律
D. 维拉帕米
E. 地尔硫䓬

正确答案：A。胺碘酮

解析：本题考查胺碘酮。通过抑制钾通道，延长动作电位时程的抗心律失常药物是胺碘酮（A对）。抗心律失常药按其作用于心肌细胞的电活动的机制分为：（1）钠通道阻滞剂（第I类），该类药又可以细分为三个亚类：Ⅰa类如奎尼丁；Ib类如美西律（C错）等；Ic类如普罗帕酮（B错）。（2）β受体阻断剂（第Ⅱ类）。（3）延长动作电位时程药（第Ⅲ类）。（4）钙通道阻滞剂（第IV类），临床常用的有非二氢吡啶类钙通道阻滞剂维拉帕米（D错）和地尔硫䓬（E错）。